急性低钾血症对心肌膜电位的影晌是
A. 静息电位（负值）下降，阈电位（负值）不变，静息电位与阈电位间差距降低
B. 静息电位（负值）下降，阈电位（负值）下降，静息电位与阈电位间差距不变
C. 静息电位（负值）下降，阈电位（负值）下降，静息电位与阈电位间差距下降
D. 静息电位（负值）升高，阈电位（负值）不变，静息电位与阈电位间差距升高
E. 静息电位（负值）升高，阈电位（负值）升高，静息电位与阈电位间差距升高

正确答案：A。静息电位（负值）下降，阈电位（负值）不变，静息电位与阈电位间差距降低

解析：低钾血症时由于细胞外液钾浓度降低，心肌细胞膜对K⁺的通透性下降，静息电位(Em)负值减小（DE错），与阈电位(Et)之间的距离(Em-Et)减小（A对）。钾离子浓度改变不影响阈电位水平（BC错）。